一般重要炮制绝对含水量应该控制在
A. 3-5%
B. 5-10%
C. 7-13%
D. 14-16%
E. 15-18%

正确答案：C。7-13%

解析：本题考查的是炮制绝对含水量。一般重要炮制绝对含水量应该控制在7-13%（C对）。一般炮制品的绝对含水量应控制在7%～13%，贮存环境的相对湿度应控制在35%～75%。